肺炎链球菌在培养基上自溶形成脐状菌落的时间是
A. 1小时
B. 6小时
C. 12小时
D. 24小时
E. 48小时

正确答案：D。24小时

解析：肺炎链球菌：革兰氏染色为阳性，矛头状成双排列，无鞭毛，不形成芽胞，有些毒株可形成荚膜，在血琼脂培养基平板上形成α-溶血环。此菌可产生自溶酶，培养24小时后菌体自溶形成脐状菌落。自溶酶可被胆汁激活加速细菌溶解。肺炎链球菌可发酵菊糖，故胆汁溶菌试验及菊糖发酵试验可鉴别肺炎链球菌与甲型溶血性链球菌。掌握“链球菌属”知识点。